防风通圣丸的功能是
A. 疏风解表
B. 宣肺止咳
C. 解表通里
D. 解肌清热
E. 益气解表

正确答案：C。解表通里

解析：本题考查的是防风通圣丸的功能。防风通圣丸的功能是解表通里（C对）。防风通圣丸：【功能】解表通里，清热解毒。银翘解毒丸：【功能】疏风解表（A错），清热解毒。桑菊感冒片：【功能】疏风清热，宣肺止咳（B错）。葛根芩连丸：【功能】解肌透表，清热（D错）解毒，利湿止泻。参苏丸：【功能】益气解（E错）表，疏风散寒，祛痰止咳。